既阻断β受体又阻断α受体的是
A. 普萘洛尔
B. 拉贝洛尔
C. 阿托品
D. 酚妥拉明
E. 美托洛尔

正确答案：B。拉贝洛尔